男孩，4岁，跑跳后左膝痛1周，未经诊治，1天前疼痛加重，伴发热，呕吐。查体：T39.6℃，P160次/分。左膝强迫微屈位，局部压痛（＋），肿胀不明显。实验室检查：血WBC25×10⁹/L，N0.92。患膝及小腿X线片均未见异常。最可能的诊断是
A. 半月板损伤
B. 急性血源性骨髓炎
C. 恶性肿瘤
D. 急性蜂窝织炎
E. 急性风湿性关节炎

正确答案：B。急性血源性骨髓炎

解析：4岁男性儿童患者（好发人群），跑跳后左膝痛1周（可能有外伤史），1天前疼痛加重，伴发热，呕吐。查体：T39.6℃，P160次/分（提示感染，全身症状明显）。左膝（急性血源性骨髓炎好发部位）强迫微屈位，局部压痛（＋），肿胀不明。实验室检查：血WBC25×10⁹/L（正常值为4～10×10⁹/L），N0.92（正常值为0.5～0.7）。患膝及小腿X线片均未见异常。综合患者年龄特征、病史及体格检查，考虑诊断为急性血源性骨髓炎（B对）。半月板损伤（A错）多见于运动员和体力劳动者，表现为膝关节剧痛，不能伸直，并迅速出现肿胀，有时有关节内积血。骨恶性肿瘤（C错）几乎均有局部疼痛，为慢性过程，部位以骨干居多，一般无全身感染症状，故不选。急性蜂窝织炎脓毒症症状比急性骨髓炎轻，且部位不一致，急性骨髓炎好发于干骺端，而蜂窝织炎与脓肿则不常见于此处；体征不一样：急性骨髓炎疼痛剧烈，但压痛部位深，表面红肿不明显，出现症状与体征分离现象，而软组织感染则局部炎性反应明显，故排除急性蜂窝织炎（D错）。儿童类风湿关节炎，也可出现高热，常与一过性斑丘疹和多形红斑同时发生和消退，且肝、脾、淋巴结多肿大，患儿无相关病史，故排除急性风湿性关节炎（E错）。